在噪声对听觉系统损伤的发病过程中，最具特征性的表现是
A. 早期高频段听力下降
B. 早期属于功能性听觉敏感性下降
C. 晚期低频段听力下降
D. 听阈升高在后期不能恢复到正常的水平
E. 听力下降呈递减性，选快后慢

正确答案：D。听阈升高在后期不能恢复到正常的水平

解析：听阈升高在后期不能恢复到正常的水平（D对）是噪声引起听觉器官的损伤时由生理变化到病理改变的过程，即先出现暂时性听阈位移，暂时性听阈位移如不能得到有效恢复，则逐渐发展为永久性听阈位移。早期高频段听力下降（A错）、早期属于功能性听觉敏感性下降（B错）、晚期低频段听力下降（C错）、听力下降呈递减性，选快后慢（E错）均是噪声造成听觉系统损伤的发病过程中，某一阶段的表现。